短效口服避孕药含
A. 雌激素
B. 孕激素
C. 雌激素+雄性激素
D. 孕激素+雄性激素
E. 雌激素+孕激素

正确答案：E。雌激素+孕激素

解析：短效口服避孕药是雌、孕激素（E对）组成的复合制剂